尊重病人的人格，保守有关病人的秘密，是
A. 执业药师的权力
B. 执业药师的义务
C. 执业药师的权利
D. 执业药师的执业行为规范
E. 执业药师的道德准则

正确答案：E。执业药师的道德准则

解析：本题考查执业药师的道德准则。尊重病人的人格，保守有关病人的秘密，是执业药师的道德准则（E对）。执业药师的道德准则包括：1.救死扶伤，不辱使命；2.尊重患者，平等相待；3.依法执业，质量第一；4.进德修业，珍视声誉；5.尊重同仁，密切协作。执业药师的权力（A错）包括：1、执业药师全权负责药品质量和药学服务质量管理工作；2、执业药师有权审核、监督医师的处方。对配伍禁忌或超剂量的处方，以及危及用药安全、有效、合理的处方，有权拒绝调配；3、在保证药品质量和疗效等同，并且在购药者要求或同意的情况下，执业药师有权以更经济的其它商品名的该种药品进行替换，但国家特殊管理的药品和处方药除外；4、在患者生命安全存在危险的特殊情况下，执业药师有权紧急提供处方药品，但事后必须如实记录，并立即向执业药师管理机构报告说明情况；5、在没有医疗机构的地方，或者说在没有执业医师时的紧急救灾、救护的情况下，执业药师有权提供处方药品；6、执业药师有权根据医师的诊断和医嘱向长期服用某种处方药品的慢性病患者提供该种处方药品；7、执业药师有权指导、监督和管理其技术助理的处方调配、销售或供应过程。对于不正确的处方药调配、销售或供应，执业药师有权给予纠正；8、执业药师有权拒绝明显导致危害用药者生命健康、违反社会伦理道德的售药要求。9、执业药师有权否定危及安全、有效、合理用药方案；10、执业药师有权否定危及药品质量的购进品种、购进渠道、管理药品储存过程；11、执业药师有权依法签署有关药学业务文件；12、执业药师有权选择接受继续教育的选修、自修内容及其形式和时间。在各国制定的药师道德准则中，药师的义务（B错）应包括：①合理、公平地分配现有的健康资源；②保证服务对象的安全、健康和最大利益，并以诚相待；③与其他卫生工作人员合作，确保向患者和社会提供可能的最佳卫生保健质量。执业药师的权利（C错）包括：1、任何组织和个人都应该尊重执业药师。执业药师人格尊严和人身安全受到保护；2、执业药师有权备用执业所需的药学专业手册和相关法律手册，订阅执业所需的杂志；3、执业药师可以并且应该依法组织自律性协会组织，参加协会组织的药学技术业务等活动，接受协会组织依法进行的自律性管理；4、执业药师有权参加旨在提高药学专业、法律素质的各种形式的继续教育；5、执业药师有权依法进行科学研究、新产品、新技术开发和学术交流；6、执业药师有权争取并获得正当、合理的执业报酬；7、执业药师有权向执业药师管理机构投诉侵害其权利的行为；8、执业药师有权就执业药师管理机构对自己作出的处罚提出质疑，要求更正、或依法申请行政复议及行政诉讼；9、对于技术精湛、行为高尚、贡献突出的执业药师应受到有关方面的表彰和奖励。执业药师的执业行为规范（D错）包括：1、维护病患者和公众的健康利益。2、按规定进行注册、参加继续教育，依法在合法的单位从事合法的药学技术业务活动。3、提供各类用药咨询。4、对其调配的药品及其他职责范围内的关键药学技术业务负责，不得将其职责范围内的关键药学技术工作交由其助实习生等非执业药师人员单独进行。5、对于在执业过程中知晓的他人的秘密，不得无故泄露。